流脑实验室检查首选
A. 脑脊液涂片镜检
B. 血液涂片镜检
C. 胸水涂片镜检
D. 痰涂片镜检
E. 大便涂片镜检

正确答案：A。脑脊液涂片镜检

解析：脑脊液检查是诊断流脑的重要方法。病初或休克型患者，脑脊液多无改变，应12～24 小时后复查。典型的脑膜炎期，压力增高，外观呈浑浊米汤样甚或脓样；白细胞数明显增高至1000×10⁶/L 以上，以多核细胞为主；糖及氯化物明显减少，蛋白含量升高（A对）。